关于抗抑郁药的使用注意事项，正确的有
A. 选择抗抑郁药物时需考虑患者的症状特点、年龄、药物的耐受性、有无合并症等因素
B. 大多数抗抑郁药起效缓慢，需4～6周方能见效
C. 在足量足疗程治疗无效的情况下，可考虑更换另一种作用机制不同的抗抑郁药
D. 抗抑郁药需从小剂量开始并逐渐增加剂量，且尽可能采用最小有效剂量维持
E. 单胺氧化酶抑制剂可与5-羟色胺再摄取抑制剂联合治疗抑郁症

正确答案：A、B、C、D。选择抗抑郁药物时需考虑患者的症状特点、年龄、药物的耐受性、有无合并症等因素；大多数抗抑郁药起效缓慢，需4～6周方能见效；在足量足疗程治疗无效的情况下，可考虑更换另一种作用机制不同的抗抑郁药；抗抑郁药需从小剂量开始并逐渐增加剂量，且尽可能采用最小有效剂量维持

解析：本题考查抗抑郁药的使用。抗抑郁药的应用因人而异，须全面考虑患者症状特点、年龄、躯体状况、药物的耐受性、有无合并症（A对），予以个体化合理用药。使用抗抑郁药时，应从小剂量开始，逐增剂量，尽可能采用最小有效量（D对），使不良反应减至最少，以提高服药依从性。当小剂量疗效不佳时，可根据不良反应和患者对药物的耐受情况，逐渐增至足量。。抗抑郁药起效缓慢，大多数药物起效需要一定的时间，并且需要足够长的疗程，一般4～6周方显效（B对），即便是起效较快的抗抑郁药如米氮平和文拉法辛，也需要1周左右的时间，因此要有足够的耐心，切忌频繁换药。只有在足量、足疗程使用某种抗抑郁药仍无效时，方可考虑换用同类另一种或作用机制不同的另一类药（C对）。单胺氧化酶抑制剂不可与5-羟色胺再摄取抑制剂合用（E错），选择性5-HT再摄取抑制剂与单胺氧化酶抑制剂合用可引起5-HT综合征，表现为不安、肌阵挛、健反射亢进、多汗、震颤、腹泻、高热、抽搐和精神错乱，严重者可致死。